影响环境污染物对健康危害程度的因素有以下各项，但不包括
A. 剂量或强度
B. 作用持续时间
C. 受害的人群数量
D. 个体差异
E. 多种因素综合作用

正确答案：C。受害的人群数量

解析：本题考查影响环境污染物对健康危害程度的因素。影响环境污染物对健康危害程度的因素包括剂量或强度（A对）、作用持续时间（B对）、个体差异（D对）和多种因素综合作用（E对）等。受害的人群数量（C错，为本题正确答案）不是影响环境污染物对健康危害程度的因素。